左心房增大合并明显肺动脉高压时心界呈
A. 普大形
B. 三角烧瓶形
C. 球形
D. 梨形
E. 靴形

正确答案：D。梨形

解析：左心房增大合并明显肺动脉高压时胸骨左缘第2、3肋间心界增大，心腰更为丰满或膨出，心界呈梨形（D对），临床常见于二尖瓣狭窄。心界呈普大型（A错）是指左、右心室增大心浊音界向两侧增大，且左界向左下增大，临床常见于扩张型心肌病。心界呈三角烧瓶形（B错）是指心浊音界向两侧增大，相对、绝对浊音界几乎相同，并随体位而改变，坐位时心界呈三角烧瓶形，临床常见于心包积液。心界呈球形（C错）是指全部房室都扩张，常见于二尖瓣关闭不全。心界呈靴形（E错）是指左心室增大，心浊音界向左下增大，心腰加深，临床常见于主动脉瓣关闭不全。